冬季出生一男婴，足月顺产，现已4个月，体重5.8kg，只母乳喂养，未添加辅食，近日来，婴儿多烦躁，易激惹，夜惊，多汗，血钙、碱性磷酸酶正常，血磷低，最可能的诊断是
A. 惊吓
B. 营养不良
C. 佝偻病活动期
D. 佝偻病早期
E. 先天性佝偻病

正确答案：D。佝偻病早期

解析：佝偻病初期（早期）多见于6个月以内，特别是＜3个月的婴儿，主要表现为非特异性的神经兴奋性增高症状，如易激惹，烦躁，睡眠不安，夜间惊啼，多汗（与季节无关），枕秃（因烦躁及头部多汗致婴儿常摇头擦枕）。血钙正常或稍低，血磷低，钙磷乘积稍低（30～40），血清25-（0H）D3，下降，碱性磷酸酶正常或增高。此期无骨骼改变，X线片检查多正常，或仅见临时钙化带模糊。掌握“维生素D缺乏性佝偻病”知识点。